相同浓度和剂量的局麻药，毒性最小的是
A. 利多卡因
B. 普鲁卡因
C. 地卡因
D. 布比卡因
E. 丙胺卡因

正确答案：B。普鲁卡因

解析：本题考查常用局部麻醉药的比较。相同浓度和剂量的局麻药，毒性最小的是普鲁卡因（B对）。以普鲁卡因的毒性强度等于1作为标准，布比卡因（D错）是4，利多卡因（A错）是2。普鲁卡因虽大剂量［1～2mg/（kg▪min）］也不致引起毒性反应。地卡因（C错）又称丁卡因，毒性大，不宜注入体内；大剂量时可抑制心脏传导系统及中枢神经系统。丙胺卡因（E错）当剂量超过600mg时，代谢产生的邻甲苯胺，还原血红蛋白为正铁血红蛋白，且血中正铁血红蛋白超过1.5g/dl时，临床上可出现青紫、血红蛋白尿等并发症。